评价一所医院感染监测质量好坏的重要标志是
A. 医院感染发生率
B. 医院感染漏报率
C. 医院感染患病率
D. 医院感染续发率
E. 医院感染例次发生率

正确答案：B。医院感染漏报率